内痔好发于，肛门齿线上
A. 截石位3、7、11点
B. 截石位3、9点
C. 截石位6、12点
D. 截石位1、8点
E. 截石位4、10点

正确答案：A。截石位3、7、11点

解析：内痔，是指肛门齿状线以上，直肠末端黏膜以下的痔内静脉丛扩大曲张和充血所形成的柔软静脉团，其临床特点为便血，痔核脱出，肛门不适。好发于截石位3、7、11点（A对）好发于结石位3、9点的是血栓性外痔（B错）。好发于截石位6、12点处的为结缔组织外痔，常由肛裂引起，又称哨兵痔或裂痔（C错）。没有好发于截石位1、8点和截石位4、10点的痔（DE错）。